某城市在制定控烟策略时，要求烟民禁止在公共场合吸烟，这从非烟民角度考虑是
A. 维护公共安全
B. 维护公共卫生
C. 维护城市形象
D. 减少被动吸烟
E. 减少事故的发生

正确答案：D。减少被动吸烟

解析：非烟民以往常被动吸入吸烟者呼出的烟雾及卷烟燃烧产生的烟雾，这些烟雾中含有多种有毒物质和致癌物，危害着被动吸烟者的健康。因此，某城市在制定控烟策略时，要求烟民禁止在公共场合吸烟，这从非烟民角度考虑是减少被动吸烟（D对）。维护公共安全（A错）、维护公共卫生（B错）、维护城市形象（C错）及减少事故的发生（E错）均是禁止在公共场合吸烟的目的之一，是从公共安全、卫生及城市形象等方面考虑的。